产生IL-4的是
A. Th1
B. Th2
C. CTL
D. NK
E. Mφ

正确答案：B。Th2